哺乳纲动物牙形及附着于颌骨的方式为
A. 同形牙，有较完善的牙根，位于颌骨的牙槽窝
B. 同形牙，无牙根，借纤维膜附着于颌骨的边缘
C. 异形牙，牙根发达，深埋于颌骨的牙槽窝内
D. 同形牙，有较完善的牙根，借纤维膜附着于颌
E. 异形牙，牙根小，埋于颌骨的一侧

正确答案：C。异形牙，牙根发达，深埋于颌骨的牙槽窝内

解析：本题考查哺乳纲动物的牙形及附着于颌骨的方式。哺乳纲动物的牙是异形牙，牙根发达、深埋于颌骨的牙槽窝内（C对E错）。爬行类动物的牙是同形牙，有较完善的牙根，位于颌骨的牙槽窝（A错）。鱼类的牙是同形牙、无牙根、借纤维膜附着于颌骨的边缘（BD错）。